不属于副交感神经节的是
A. 耳神经节
B. 翼腭神经节
C. 腹腔神经节
D. 睫状神经节
E. 壁内节

正确答案：C。腹腔神经节

解析：周围部的副交感神经节，位于器官的周围或器官的壁内，称器官旁节和器官内节（E对），位于颅部的副交感神经节较大，肉眼可见，有睫状神经节（D对）、下颌下神经节、翼腭神经节（B对）和耳神经节（A对）等。腹腔神经节（C错，为本题正确选项）属于交感神经。